初产妇，胎头吸引器加会阴侧切助产分娩足月活婴，胎盘胎膜完整。产后4小时阴道流血约500ml。查：BP90/60mmHg，脉搏100次/分，宫底脐上3横指，轮廓不清，阴道口少量活动性流血，可凝固。首选处理措施是
A. 按摩子宫
B. 导尿
C. 注射止血剂
D. 检查软产道
E. 刮宫

正确答案：A。按摩子宫

解析：该孕妇产后4小时出血约500ml，血压90/60mmHg（偏低），脉搏100次/分，阴道口少量活动性出血，应诊断为产后出血。宫底脐上3横指，轮廓不清（正常情况下胎盘娩出后，宫底平脐或脐下一横指，子宫收缩呈球状、质硬。子宫收缩乏力时，宫底升高，子宫质软、轮廓不清，阴道流血多），可考虑为子宫收缩乏力导致的产后出血。子宫收缩乏力导致的出血，加强宫缩能迅速止血，故首选处理措施是按摩子宫（A对）。如按摩子宫效果不佳，则采取应用缩宫剂，如还是出血则采用宫腔纱条填塞，若还是效果不好，则手术治疗。导尿（B错）适用于尿潴留导致的产后出血，不能缓解子宫收缩乏力所引起的出血。注射止血剂（C错）为一般性止血措施，对产后出血效果不佳。软产道裂伤的患者，胎儿娩出后立即发生阴道流血，色鲜红，本题不符合，不需检查软产道（D错）。刮宫（P348）（E错）用于诊断性活组织检查，治疗不规则子宫出血或清除胚胎组织。